玉枢丹辟秽解浊，利气宣壅，适用于霍乱的哪种证型
A. 干霍乱
B. 热霍乱轻证
C. 热霍乱重证
D. 寒霍乱轻证
E. 寒霍乱重证

正确答案：A。干霍乱

解析：玉枢丹具有辟浊解秽，利气宣壅的功效，用于治疗霍乱中的干霍（A对）；热霍乱轻证（B错）用燃照汤；热霍乱重证（C错）用白虎汤；寒霍乱轻证（D错）用藿香正气散以芳香化湿；寒霍乱重证（E错）用理中汤以回阳固脱。